牙齿发育的开始是
A. 成釉器的出现
B. 牙乳头的发育
C. 牙囊的分化
D. 牙板的发生
E. 牙胚的形成

正确答案：D。牙板的发生

解析：牙胚由牙板及邻近的外胚间叶组织发育而来，牙板的发生是牙齿发育的开始。